下列不属于药物不良反应的是
A. 副作用
B. 拮抗作用
C. 毒性反应
D. 后遗效应
E. 变态反应

正确答案：B。拮抗作用

解析：拮抗作用（B错，为本题正确答案）是指药物合用后原有作用或毒性减弱，根据其产生机制可分为药理性拮抗、生理性拮抗、生化性拮抗、化学性拮抗。凡不符合用药目的的，并给患者带来不适或痛苦的反应统称为不良反应，不良反应主要可分为副作用（A对）、毒性反应（C对）、后遗效应（D对）、变态反应（E对）、后遗效应、继发反应、特异质反应、药物依赖性。其中副作用是指药物在治疗剂量时与治疗作用同时发生的与治疗作用无关的作用，一般较轻微，多可自行恢复。毒性反应是指药物剂量过大或用药时间过长而引起的机体损害性反应，一般较严重。变态反应是指少数人对某些药物产生的病理性免疫反应。这种反应只发生在少数过敏体质的患者。后遗效应是指停药后原血药浓度已下降至阈浓度以下而残存的药理效应。